中医遣药组方时，生姜配黄芩属于
A. 相须配伍
B. 相使配伍
C. 相恶配伍
D. 相杀配伍
E. 相反配伍

正确答案：C。相恶配伍

解析：本题考查中药的七情配伍注意事项。中医遣药组方时，生姜配黄芩属于相恶配伍（C对）。七情配伍是中药配伍最基本的理论，是中医遗药组方的基础。七情是单行、相使（B错）、相须（A错）、相畏、相杀、相恶、相反（E错）的合称，用以说明中药配伍后药效，毒性变化的关系。中药配伍应用注意事项：①有些药物因产生协同作用而增进疗效，是临床用药时要充分利用的。如相须配伍中，金银花配连翘，可增强辛凉解表、疏散风热的作用。相使配伍中，枸杞子配菊花，枸杞子补肾益精、补肝明目为主药，菊花清肝泻火，兼能益阴明目，可增强枸杞子补肝明目的作用；②有些药物可能互相拮抗而抵消、削弱原有功效，用药时应加以注意，如生姜可温胃止呕，黄芩药性寒凉，可削弱生姜的温胃作用，即生姜恶黄芩，两药应避免同用；③有些药物则由于相互作用，而能减轻或消除原有的毒性或副作用，在应用毒性药或剧烈药时必须考虑选用，如相畏、相杀（D错）配伍：半夏畏生姜，或生姜杀半夏，生姜可以抑制半夏的毒副作用；④另一些本来单用无害的药物，却因相互作用而产生毒性反应或强烈的副作用，则属于配伍禁忌，原则上应避免配用，如相反。